位于蝶鞍两侧的硬脑膜窦是
A. 上矢状窦
B. 横窦
C. 乙状窦
D. 下矢状窦
E. 海绵窦

正确答案：E。海绵窦

解析：位于蝶鞍两侧的硬脑膜窦是海绵窦（E对）。上矢状窦（A错）位于大脑镰上缘内；下矢状窦（D错）位于大脑镰下缘内；横窦（B错）位于小脑幕后外侧缘附着处的枕骨横窦沟处；乙状窦（C错）位于乙状窦沟内，是横窦的延续。